外伤导致患者左手指拇指，食指，中指可屈曲，不能对掌，桡侧3个半手指感觉障碍，神经损伤为
A. 正中神经
B. 肌皮神经
C. 臂丛神经
D. 桡神经损伤
E. 尺神经损伤

正确答案：A。正中神经

解析：外伤导致患者左手指拇指，食指，中指可屈曲，不能对掌，桡侧3个半手指感觉障碍，神经损伤为正中神经损伤（肘上）（A对）。桡神经损伤一般有垂腕表现（D错）。尺神经损伤一般有爪形手表现（E错）。肌皮神经（B错）支配喙肱肌、肱二头肌和肱肌，臂丛神经（C错）支配肩、背、胸部和上肢的肌肉，损伤表现为上臂丛（肩外展和屈肘功能障碍）、下臂丛（尺神经支配肌肉麻痹及部分正中神经和桡神经功能障碍）、全臂丛神经（整个上肢肌呈弛缓性麻痹）损伤。